关于晚期癌症患者缓和医疗的说法，正确的有
A. 正视生命的全过程（生、老、病、死），尊重患者和家属的意愿
B. 全面管理患者的不适症状，提高其生活质量
C. 尽可能尝试现有治疗方法，对原发病进行积极治疗
D. 总体原则是“尊重、有益、不伤害和公平”
E. 提倡跨学科团队（包括医疗、护理、营养、心理支持、志愿者服务）提供“全人性化管理”服务

正确答案：A、B、D、E。正视生命的全过程（生、老、病、死），尊重患者和家属的意愿；全面管理患者的不适症状，提高其生活质量；总体原则是“尊重、有益、不伤害和公平”；提倡跨学科团队（包括医疗、护理、营养、心理支持、志愿者服务）提供“全人性化管理”服务

解析：本题考查晚期癌症患者缓和医疗。世界卫生组织对缓和医疗理念的进一步解释为：①正视生命的全过程（生、老、病、死），尊重死亡的正常过程，既不促进也不推延死亡（A对）。②提供有效缓解疼痛和其它不适症状的疗护措施，结合心理精神治疗，给予全面的支持（E对），尽可能提高患者的生活质量（B对）。③注意对家属的帮助和支持，使其能够面对患者病期和死后的诸多问题。总之，通过患者和家庭成员的共同参与，形成以患方为中心的医疗方式，以改善患者的生活质量为目的，预防和治疗患者所承受的痛苦，努力达到患者的期望值，帮助患者有尊严地走完人生的最后一程（D对）。